根据《药品说明书和标签管理规定》，下列叙述错误的是
A. 药品说明书由省级人民政府药品监督管理部门核准
B. 药品标签由国务院药品监督管理部门核准
C. 药品包装必须按照规定印有标签
D. 药品包装必须按照规定贴有标签
E. 药品生产企业生产供上市销售的最小包装必须附有说明书

正确答案：A。药品说明书由省级人民政府药品监督管理部门核准

解析：本题考查说明书、标签的印制和文字表述。药品说明书的内容由国家药品监督管理部门予以核准（A错，为本题正确答案）。说明书、标签的印制和文字表述的核准内容：药品说明书和标签的内容由国家药品监督管理部门予以核准（B对），药品生产企业印制时，应当按照国家药品监督管理局规定的格式和要求、根据核准的内容印制说明书和标签，不得擅自增加或删改原批准的内容。药品的标签应当以说明书为依据，其内容不得超出说明书的范围，不得印有暗示疗效、误导使用和不适当宣传产品的文字和标识。药品包装必须按照规定印有或者贴有标签（CD对），也不得夹带其他任何介绍或者宣传产品、企业的文字、音像及其他资料。因此，药品标签不得印制“××省专销”“原装正品”“进口原料”“驰名商标”“专利药品”“××监制”“××总经销”“××总代理”等字样。但是，“企业防伪标识”“企业识别码”“企业形象标志”等文字图案可以印制。以企业名称等作为标签底纹的，不得以突出显示某一名称来弱化药品通用名称。“印刷企业”“印刷批次”等与药品的使用无关的，不得在药品标签中标注。药品说明书由药品生产企业依照国家规定的格式要求，以及批准的内容编写，上市销售药品的最小包装中应附有药品说明书（E对）。